关于眼膏剂及其制备的叙述，正确的有
A. 眼膏剂为供眼用的灭菌半固体制剂
B. 眼膏基质必须灭菌，且应纯净细腻
C. 眼膏基质灭菌一般采用150℃热压灭菌1-2h
D. 凡士林8份、液状石蜡、羊毛脂各1份制成的基质，尤适用于作为抗生素和中药眼膏的基质
E. 除基质、器具、包装材料等应严格灭菌外，眼膏制备时还应无菌操作

正确答案：A、B、D、E。眼膏剂为供眼用的灭菌半固体制剂；眼膏基质必须灭菌，且应纯净细腻；凡士林8份、液状石蜡、羊毛脂各1份制成的基质，尤适用于作为抗生素和中药眼膏的基质；除基质、器具、包装材料等应严格灭菌外，眼膏制备时还应无菌操作